大叶性肺炎患者引起乏氧性缺氧时
A. 血氧容量下降
B. 动脉血氧饱和度正常
C. 动脉血氧分压下降
D. 静脉血氧含量正常
E. 动－静脉氧差增大

正确答案：C。动脉血氧分压下降

解析：动脉血氧分压降低（C对）、动脉血氧含量降低（D错）、动脉血氧容量正常或升高（A错）、动脉血氧饱和度降低（B错）、动-静脉血氧含量差正常或降低（E错）是乏氧性缺氧的血氧变化特点。